在一项队列研究中，非暴露组150名中15人患高血压，暴露组200人中30人患高血压。归因危险度为
A. 0.15
B. 0.1
C. 1.5
D. 0.05
E. 0.25

正确答案：D。0.05

解析：归因危险度是暴露组发病率与对照组发病率的差值，由题目可知，在该项队列研究中，非暴露组150名中15人患高血压，暴露组200人中30人患高血压，归因危险度为：AR=30/200-15/150=0.05（D对）。